关于热原去除方法的说法正确的有
A. 活性炭可吸附去除药液中的热原
B. 100℃、60分钟煮沸灭菌可彻底破坏药液中的热源
C. 玻璃器皿可采用重铬酸钾硫酸清洁液处理破坏热原
D. 采用0.22微米的微孔滤膜可滤除药液中的热原
E. 超滤膜可截留去除药液中相对分子质量大的热源

正确答案：A。活性炭可吸附去除药液中的热原

解析：本题考查的是除去热原的方法。关于热原去除方法的说法正确的有活性炭可吸附去除药液中的热原（A对）。去除热原的方法：（1）高温法：耐热器具洁净干燥后于180℃加热2小时或250℃加热30分钟以上可破坏热原（B错）。（2）酸碱法：耐酸碱的玻璃容器、瓷器或塑料制品，可采用重铬酸钾硫酸清洁液或稀氢氧化钠溶液处理破坏热原（C错）。（3）吸附法：活性炭具有较强的吸附热原作用，同时兼有助滤、脱色作用。应选用针用规格活性炭，常用量为0.1%～0.5%。此外，活性炭与硅藻土合用也可除去热原。（4）离子交换法：热原分子上含有负电荷的磷酸根与羧酸根，强碱性阴离子交换树脂可吸附除去溶剂中的热原。（5）凝胶滤过法：利用热原与药物分子量的差异将两者分开。溶液通过凝胶柱时，分子量较小的成分渗入到凝胶颗粒内部而被阻滞，分子量较大的成分则沿凝胶颗粒间隙随溶剂流出。（6）超滤法：利用高分子薄膜的选择性与渗透性，在常温条件下，依靠一定的压力和流速，从而除去溶液中的热原。用于超滤的高分子薄膜孔径可控制在50nm以下，其滤过速度快，除热原效果明显（DE错）。（7）反渗透法：选用三醋酸纤维素膜或聚酰胺膜进行反渗透可除去热原。